桩核冠修复中，对所修复残冠的错误处理为
A. 沿龈乳头顶连线切断
B. 去除腐质
C. 去除薄壁
D. 去除无基釉
E. 尽可能保留残冠硬组织

正确答案：A。沿龈乳头顶连线切断

解析：本题考查桩核冠修复。桩核冠修复中，对所修复残冠的错误处理为沿龈乳头顶连线切断（A错，为本题的正确答案）。对于桩核冠修复后的远期效果来说，剩余牙体组织的量和牙本质肩领的意义远远大于桩、核或全冠材料的选择，所以要尽可能保留残冠硬组织（E对）；牙本质肩领要求最终全冠修复体的边缘至少包过剩余牙体组织断面高度的1.5～2.0mm，可以提高牙齿完整性，增强牙齿的抗折强度，防止冠折根裂。沿龈乳头顶连线切断则必然无法形成牙本质肩领，也违背了尽量保留剩余牙体组织的原则。要去除腐质（B对）以防止继发龋的发生，导致修复失败。去除薄壁（C对）和无基釉（D对）这些薄弱牙体组织才能降低牙齿折裂的风险。